盐皮质激素、糖皮质激素、性激素的总称是
A. 生长激素
B. 促生长激素
C. 肾上腺皮质激素
D. 促性腺激素释放激素
E. 抗生素

正确答案：C。肾上腺皮质激素

解析：肾上腺皮质由外向内依次分为球状带、束状带及网状带三层。球状带约占皮质的15%，因缺乏17α-羟化酶只能合成醛固酮和去氧皮质酮等盐皮质激素；束状带约占78%，是合成氢化可的松等糖皮质激素的重要场所；网状带约占7%，主要合成性激素类。肾上腺皮质激素是上述各种激素的总称，属甾体类化合物。掌握“糖皮质激素”知识点。